女性，72岁，摔倒后左髋疼痛伴不能活动3小时，查体见左下肢缩短，外旋畸形，X线显示左侧股骨头下骨皮质不连续，断端部分吻合，Garden分型是
A. Ⅰ
B. Ⅱ
C. Ⅲ
D. Ⅳ
E. V

正确答案：C。Ⅲ

解析：老年患者，有摔伤史，左下肢缩短、外旋畸形（股骨颈骨折的表现和畸形），结合患者的年龄，病史，表现和查体，提示为左股骨颈骨折，股骨颈骨折的典型畸形是患肢缩短、轻度外旋（一般为45°～60°）。X线显示左侧股骨头下骨皮质不连续（完全骨折），断端部分吻合（部分移位股骨头与股骨颈有接触），Garden分型为Ⅲ型（C对）。Ⅰ型（A错）不完全骨折，Ⅱ  型（B错）无移位的完全骨折， Ⅳ型（D错）完全骨折，完全移位，无Ⅴ型（E错）。